脊髓压迫症中，脊髓外硬膜内和神经根处最常见病变为
A. 神经纤维瘤
B. 脓肿
C. 结核
D. 转移瘤
E. 血管瘤

正确答案：A。神经纤维瘤

解析：脊髓压迫症中，脊髓外硬膜内和神经根处最常见病变为神经纤维瘤（A对）。脓肿（B错）一般好发于长骨干骺端而非脊髓；结核（C错）一般继发于肺结核，好发于脊柱、膝关节和髋关节，而非脊髓外硬膜内和神经根处；虽然大多数椎管内转移瘤（D错）位于硬脊膜外，但其并不是脊髓外硬膜内和神经根处最常见病变；血管瘤（E错）呈浸润性生长，为良性肿瘤，好发于大血管，并不在脊髓外硬膜内和神经根处发生。